下列关于禽流感病毒的叙述，错误的是
A. 属正黏病毒科
B. 加热可灭活
C. 人对其不易感
D. 包括甲型流感病毒的全部亚型
E. 在自然环境中存活时间短暂

正确答案：E。在自然环境中存活时间短暂

解析：禽流感病毒属正黏病毒科甲型流感病毒属（A对），其病毒结构、生物学特性等与人甲型流感病毒相同（D对）。多数禽流感病毒不会导致人类患病（C对），但有些禽流感病毒亚型属人兽共患病毒，能够感染人类并致病，目前已知可以感染人类的禽流感病毒亚型有H5N1、H5N6、H7N2、H7N3、H7N7、H7N9、H9N2、H10N7、H10N8等，多属低致病性。禽流感病毒对热比较敏感，65℃加热30min或煮沸（100℃）2min以上可灭活（B对）。病毒在粪便中可存活1周，在水中可存活1个月，在pH<4.1的条件下也具有存活能力。病毒对低抗温抵力较强，在有甘油保护的情况下可保持活力1年以上（E错，为本题正确答案）。